久用可产生金鸡纳反应的药物是
A. 普萘洛尔
B. 苯妥英钠
C. 奎尼丁
D. 利多卡因
E. 胺碘酮

正确答案：C。奎尼丁

解析：本题考查奎尼丁。奎尼丁（C对）是从金鸡纳树皮中提炼出来的，久用可产生金鸡纳反应，表现为头痛、头晕、腹泻、视力模糊等。普萘洛尔（A错）是非选择性β₁与β₂肾上腺素受体阻滞剂；苯妥英钠（B错）属于ⅠB类抗心律失常药；利多卡因（D错）是用于局部麻醉及抗心律失常的药物；胺碘酮（E错）属于广谱抗心律失常药。以上四种均无金鸡纳反应。